男，20岁，平素健康，淋雨后，突发寒战高热、头痛。第2天出现右侧胸痛、咳嗽、咳痰，胸片示右上肺大片实变影。体检不会出现的体征是
A. 右上肺语颤增强
B. 右上肺叩诊浊音
C. 气管向左侧偏移
D. 急性病容
E. 脉率增快

正确答案：C。气管向左侧偏移

解析：患者为青年男性（大叶性肺炎的好发人群），淋雨后出现寒战、高热、头痛，第2天出现右侧胸痛咳嗽咳痰，胸片示右上肺大片实变影（为大叶性肺炎的典型表现），根据其临床表现和影像学检查结果，考虑诊断为大叶性肺炎。大叶性肺炎的患者通常呈急性热病容（D对），口角及鼻周有单纯疱疹。病变广泛时可出现发绀。听诊可有呼吸音减低及胸膜摩擦音，肺实变时叩诊浊音（B对），触觉语颤增强（A对）并可闻及支气管呼吸音，消散期可闻及湿啰音，心率增快（E对），有时心律不齐。气管向左侧偏移（C错，为本题正确答案）常见于右侧气胸、右侧胸腔积液，大叶性肺炎时，气管居中。